能引起食物中毒的细菌是
A. 霍乱弧菌
B. 大肠埃希菌
C. 铜绿假单胞菌
D. 副溶血弧菌
E. 志贺菌

正确答案：D。副溶血弧菌